下列有关单颌全口义齿修复天然牙中调（牙合）说法正确的是
A. 下垂牙不需要调改
B. 调磨过高牙尖
C. 过锐边缘嵴不需要调改
D. 必须先做牙髓失活
E. 低位牙需采取牙列缺失修复方法恢复（牙合）曲线

正确答案：B。调磨过高牙尖

解析：单颌全口义齿修复要点：天然牙调（牙合）；调磨过高、过锐的牙尖和边缘嵴，改善（牙合）曲线和（牙合）面形态。需要调磨较多的过长、下垂牙，必要时需先作牙髓失活。低位牙需采取牙体缺损修复方法恢复（牙合）曲线。对颌缺牙较多，而余留牙健康状况较差时，可考虑采用覆盖义齿修复，有利于义齿达到平衡。掌握“单颌全口义齿”知识点。